治疗滴虫性阴道炎，适宜使用的药物是
A. 庆大霉素
B. 呋喃妥因
C. 苄星青霉素
D. 甲硝唑
E. 左氧氟沙星

正确答案：D。甲硝唑

解析：本题考查甲硝唑。治疗滴虫性阴道炎，适宜使用的药物是甲硝唑（D对）。甲硝唑适用于肠道及肠外阿米巴病、阴道滴虫病、贾第虫病、结肠小袋纤毛虫等寄生虫病的治疗。庆大霉素（A错）用于敏感菌引起的痢疾、肠炎等肠道感染性疾病，也可用于腹部术前清洁肠腔。呋喃妥因（B错）用于对其敏感的大肠埃希菌、肠球菌属、葡萄球菌属以及克雷伯菌属、肠杆菌属等细菌所致的急性单纯性下尿路感染，也可用于尿路感染的预防。苄星青霉素（C错）用于预防风湿热复发和控制链球菌感染的流行。左氧氟沙星（E错）适用于敏感革兰氏阴性菌和革兰氏阳性细菌引起的感染及炎症。